关于冠脉循环的叙述，错误的是
A. 在心室收缩期血流量少
B. 在心室舒张期血流量多
C. 血流量约占心输出量的4%～5%
D. 动脉舒张压升高时，血流量增多
E. 心肌缺氧时血流量减少

正确答案：E。心肌缺氧时血流量减少